根据《麻醉药品和精神药品管理条例》，区域性批发企业应当
A. 经国家药品监督管理部门批准
B. 申请定点资格前，在2年内没有违反有关禁毒的法律、行政法规规定的行为
C. 经所在地的卫生行政部门批准，向本省内销售麻醉药品
D. 向教学科研单位提供科学研究使用的小包装的麻醉药品原料药
E. 自行向邻省的医疗机构供应麻醉药品以便满足边远地区需求

正确答案：B。申请定点资格前，在2年内没有违反有关禁毒的法律、行政法规规定的行为

解析：本题考查麻醉药品和精神药品的经营管理。根据《麻醉药品和精神药品管理条例》，区域性批发企业应当申请定点资格前，在2年内没有违反有关禁毒的法律、行政法规规定的行为（B对）。《麻醉药品和精神药品管理条例》第二十三条规定，麻醉药品和精神药品定点批发企业除应当具备药品管理法第十五条规定的药品经营企业的开办条件外，还应当具备下列条件：（一）有符合本条例规定的麻醉药品和精神药品储存条件；（二）有通过网络实施企业安全管理和向药品监督管理部门报告经营信息的能力；（三）单位及其工作人员2年内没有违反有关禁毒的法律、行政法规规定的行为；（四）符合国务院药品监督管理部门公布的定点批发企业布局。在本省、自治区、直辖市行政区域内从事麻醉药品和第一类精神药品批发业务的企业（以下称区域性批发企业），应当经所在地省、自治区、直辖市人民政府药品监督管理部门批准（A错）。药品经营企业不得经营麻醉药品原料药和第一类精神药品原料药。但是，供医疗、科学研究、教学使用的小包装的上述药品可以由国务院药品监督管理部门规定的药品批发企业经营（D错）。区域性批发企业可以向本省、自治区、直辖市行政区域内取得麻醉药品和第一类精神药品使用资格的医疗机构销售麻醉药品和第一类精神药品（C错）；由于特殊地理位置的原因，需要就近向其他省、自治区、直辖市行政区域内取得麻醉药品和第一类精神药品使用资格的医疗机构销售的，应当经企业所在地省、自治区、直辖市人民政府药品监督管理部门批准（E错）。